高热、头痛、呕吐，全身皮肤散在瘀点，颈项强直，最可能的诊断是
A. 结核性脑膜炎
B. 流行性脑脊髓膜炎
C. 流行性乙型脑炎
D. 伤寒
E. 中毒性细菌性痢疾

正确答案：B。流行性脑脊髓膜炎

解析：高热、头痛、呕吐，全身皮肤散在瘀点，颈项强直（脑膜炎期），最可能的诊断是流行性脑脊髓膜炎（B对）。结核性脑膜炎（A错）多有头痛、呕吐、意识障碍以及乏力、低热、盗汗等结核杆菌中毒症状。流行性乙型脑炎（P88）（C错）以高热、意识障碍、抽搐、呼吸衰竭，病理反射及脑膜刺激征为特征。伤寒（P150）（D错）主要表现为持续发热、表情淡漠、相对缓脉、玫瑰疹、肝脾大等。中毒性细菌性痢疾（P180）（E错）起病急骤，突起畏寒、高热，病势凶险，全身中毒症状严重，可出现嗜睡、昏迷及抽搐等。